患者，男，54岁。下痢日久，前天因赴宴后，出现腹痛腹泻，大便每日3次，为黏液血便，纳食减少，倦怠怯冷，舌质淡苔白腻，脉虚数。首选治疗方为
A. 连理汤
B. 理中汤
C. 胃苓汤
D. 补中益气汤
E. 真人养脏汤

正确答案：A。连理汤

解析：题中患者下痢日久，诊断为痢疾，因赴宴后发病，故为休息痢，治宜温中清肠，调气化滞，方用连理汤（A对）。理中汤温中祛寒，补气健脾，治疗脾胃虚寒证（B错）。胃苓汤健脾和中，利水化湿，主治寒湿内阻，腹痛泄泻，小便不利（C错）。补中益气汤补中益气，升阳举陷，主治脾虚气陷证，气虚发热证（D错）。真人养脏汤涩肠固脱，温补脾肾，主治久泻久痢，脾肾虚寒证（E错）。